裂体细胞是指
A. 红细胞碎片
B. 白细胞碎片
C. 血小板碎片
D. 内皮细胞碎片
E. 肌细胞碎片

正确答案：A。红细胞碎片

解析：红细胞碎片（A对BCDE错）即裂体细胞，纤维蛋白丝在微血管腔内形成细网当血流中的红细胞通过网孔时，被黏着、滞留或挂在纤维蛋白丝上，然后这些红细胞在血流不断的冲击下发生破裂，其外形呈盔形、星形、新月形等。